治疗吐血胃热炽盛证，应首选
A. 百合固金汤
B. 泻心汤
C. 泻白散
D. 知柏地黄丸
E. 龙胆泻肝汤

正确答案：B。泻心汤

解析：泻心汤功能清胃泻火，十灰散能够清热凉血，收涩止血，两方合用既能清胃热，又能止血，最宜治疗吐血胃热壅盛证，根据最佳选项的原则，仍选泻心汤清胃泻火（B对）。百合固金汤，其功用为滋养肺肾，止咳化痰，与秦艽鳖甲散合用，可用于治疗肺痨之虚火灼肺证(A错)。泻白散，其功用为清泄肺热，与黛蛤散合用，可用于治疗咳血之肝火犯肺证（C错）。知柏地黄丸，其功用为滋阴降火，可用于早泄之阴虚火旺证（D错）。龙胆泻肝汤，其功用为清泻肝胆实火，清利肝胆湿热，可用于不寐之肝火扰心证、鼻衄之肝火上炎证或吐血之肝火犯胃证（E错）。